中成药中含氯苯那敏成分重复应用时，可致
A. 急性肾衰竭
B. 膀胱颈梗阻
C. 低血糖
D. 低血钾、低血压
E. 粒细胞减少

正确答案：B。膀胱颈梗阻

解析：本题考查药物不良反应。中成药中含氯苯那敏成分重复应用时，可致膀胱颈梗阻（B对）。